出生时新生儿的头围约
A. 35cm
B. 34cm
C. 33cm
D. 32.5cm
E. 31cm

正确答案：B。34cm

解析：头围指经眉弓上缘、枕骨结节左右对称环绕头一周的长度。正常足月儿出生时头围约33～34cm（八年制儿科学第三版P33、诸福棠实用儿科学第七版P42数据是34cm，第八版儿科学P462 附录2），考虑数据参考，34cm更为准确（B对）。